世界卫生组织建议，在添加辅食的基础上母乳喂养可持续至婴儿
A. 10个月
B. 12个月
C. 18个月
D. 24个月
E. 30个月

正确答案：D。24个月

解析：本题考查婴儿喂养方式的相关内容。在添加辅食的基础上，母乳喂养可持续至2岁（D对ABCE错）及以上，保障婴幼儿获取足够的营养素和能量。